ANUG患者未能及时恰当治疗，合并感染哪一种细菌可导致走马牙疳
A. 绿脓杆菌
B. 金黄色葡萄球菌产气荚膜杆菌
C. 产气荚膜杆菌
D. 大肠杆菌
E. 变形链球菌

正确答案：C。产气荚膜杆菌

解析：本题考查急性坏死性溃疡性龈炎的临床表现。急性坏死性溃疡性龈炎是指发生于龈乳头的急性炎症和坏死，又称文森龈炎，由梭形杆菌和螺旋体引起的特殊感染，病损不波及附着龈。患处牙龈极易出血，疼痛明显，有典型的腐败性口臭，重症患者可有低热。在机体抵抗力极度底下者还可合并感染产气荚膜杆菌（C对），使面颊部组织迅速坏死，甚至穿孔，称为“走马牙疳”，此时患者有全身中毒症状甚至导致死亡。目前，走马牙疳在我国已经基本绝迹。